某电视台编辑求助于一家心理治疗中心，希望在该电视台上播放韦氏智力测验的具体内容，以引起公众对心理学的兴趣，但被心理中心的工作人员婉言拒绝。该工作人员遵循的原则是
A. 保密原则
B. 稳定性原则
C. 标准化原则
D. 回避原则
E. 客观原则

正确答案：A。保密原则

解析：心理测验的基本原则有标准化原则、保密原则、客观性原则。保密原则（A对）是指关于测验的内容、答案及记分方法只有作此项工作的有关人员才能掌握，不允许随意扩散，更不允许在出版物上公开发表，否则必然会影响测验结果的真实性。题中心理咨询师不愿公开患者所接受的智力测试量表，遵循的是保密原则。标准化原则（C错）是指测量应采用公认的标准化的工具，施测方法要严格根据测验指导手册的规定执行，这是提高测验结果的信度和效度的可靠保证。客观性原则（E错）是指心理测验的结果只是测出来的东西，所以对结果作出评价时要遵循客观性原则，也就是对结果的解释要符合受试者的实际情况。稳定化原则（B错）和回避原则（D错）不是心理测验的原则。